药材呈卵圆形，具三棱的是
A. 桃仁
B. 女贞子
C. 巴豆
D. 金樱子
E. 瓜蒌

正确答案：C。巴豆